乳牙龋病对口腔局部的影响不包括
A. 影响咀嚼功能
B. 作为病灶引起机体其他部位的病灶感染
C. 易引起新生恒牙发生龋蚀
D. 可形成临床所见的特纳牙
E. 损伤口腔黏膜软组织

正确答案：B。作为病灶引起机体其他部位的病灶感染

解析：本题考查乳牙龋病对口腔局部的影响。除了对口腔局部的影响，乳牙龋病也可影响全身健康，如由龋病转变成慢性根尖周炎可作为病灶引起机体其他部位的病灶感染（B错，为本题的正确答案）。乳牙龋病对口腔局部的影响包括：影响咀嚼功能（A对），龋损导致牙体缺损，尤其当涉及多数乳磨牙时，咀嚼功能明显降低，还可造成偏侧咀嚼。乳牙的龋损、牙体的崩坏，使食物残渣、软垢等易滞留在口腔内，口腔卫生恶化，易引起新生恒牙发生龋蚀（C对）。乳牙龋发展成根尖周炎后，炎症影响后继恒牙胚，可使其釉质发育不全，可形成临床所见的特纳牙（D对）。破损的牙冠可刺激局部舌、唇、颊黏膜，损伤口腔黏膜软组织（E对）。